某病人左侧舌前2／3味觉障碍，左舌下腺、左下颌下腺分泌障碍，左眼不能闭合，左额纹消失,左鼻唇沟消失，口角偏向右侧，该病人病变可能在
A. 右面神经的管内处
B. 左舌神经
C. 左面神经核
D. 右侧皮质核束
E. 右侧大脑皮质中央前回下1／3

正确答案：C。左面神经核

解析：面神经管外损伤主要表现为损伤侧表情肌瘫痪，如口角偏向健侧、不能鼓腮；说话时唾液从口角流出；伤侧额纹消失、鼻唇沟变平坦；眼轮匝肌瘫痪使闭眼困难、角膜反射消失等症状。该病人左侧舌前2／3味觉障碍，左舌下腺、左下颌下腺分泌障碍，左眼不能闭合，左额纹消失,左鼻唇沟消失，口角偏向右侧，由此可知病变部位在左面神经核（C对）。